服用阿托品在解除胃肠痉挛时，引起口干、心悸的不良反应属于
A. 后遗效应
B. 副作用
C. 首剂效应
D. 继发性作用
E. 变态反应

正确答案：B。副作用

解析：本题考查药物不良反应的分类。服用阿托品在解除胃肠痉挛时，引起口干、心悸的不良反应属于副作用（B对）。副作用是指在药物按正常用法用量使用时，出现的与治疗目的无关的不适反应。如阿托品用于解除胃肠痉挛时，会引起口干、心悸、便秘等副作用。后遗效应（A错）是指在停药后血药浓度已降低至最低有效浓度以下时仍残存的药理效应。首剂效应（C错）是指一些患者在初服某种药物时，由于机体对药物作用尚未适应而引起不可耐受的强烈反应。例如哌唑嗪等按照常规剂量开始治疗常可致血压骤降。继发性作用（D错）是继发于药物治疗作用之后的不良反应，是治疗剂量下治疗作用本身带来的间接结果。变态反应（E错）是指机体受药物刺激所发生的异常免疫反应，引起机体生理功能障碍或组织损伤，又称过敏反应。